预备（牙合）支托凹的方法中错误的是
A. 在缺隙侧基牙（牙合）面的近远中边缘嵴处预备
B. 支托凹呈圆三角形或匙形
C. 尽量利用上下牙咬合状态的天然间隙
D. 支托凹预备在基牙的牙本质上
E. 必要时可调磨对（牙合）牙

正确答案：D。支托凹预备在基牙的牙本质上

解析：（牙合）支托凹的预备：（牙合）支托凹一般预备在缺隙两侧基（牙合）面的近、远中边缘嵴处。铸造（牙合）支托的支托凹呈圆三角形或匙形，支托凹在基牙边缘嵴处最宽，为磨（牙合）面颊舌径的1/3，前磨牙的1/2。由边缘嵴向（牙合）面中部逐渐变窄。其近远中长度为磨牙（牙合）面近远中径的1/4，前磨牙的1/3。（牙合）支托凹底面与牙长轴的角度小于90°。（牙合）支托凹底面最深处位于边缘嵴内侧，其深度为1～1.5mm。用球形金刚砂车针，在基牙的釉质上按要求磨出支托凹的外形和深度。可用口镜及探针随时观察和探测，亦可用咬蜡片的方法观察支托凹的外形和深度，并引导基牙预备使之达到要求。（牙合）支托凹的位置尽量利用上下牙咬合状态的天然间隙，或在不妨碍咬合接触处。若上下颌牙齿咬合过紧，或对颌牙伸长，或牙齿（牙合）面磨损而牙本质过敏时，必要时也可适当调磨对（牙合）牙，但不应磨除过多牙体组织。如仍无法在边缘嵴处预备（牙合）支托凹，也可考虑改变（牙合）支托凹的位置，如上颌磨牙的颊沟、下颌磨牙的舌沟。掌握“局部义齿修复前的准备及牙体预备”知识点。